癫痫失神发作的首选药物是
A. 地西泮
B. 扑米酮
C. 丙戊酸钠
D. 卡马西平
E. 苯巴比妥

正确答案：C。丙戊酸钠

解析：卡马西平是部分性发作的首选药物（D错），丙戊酸钠是全面性发作，尤其是GTCS（全身强直阵挛性癫痫发作）合并典型失神发作的首选药，也用于部分性发作（C对）。苯巴比妥常作为小儿癫痫的首选药物，较广谱，起效快，对GTCS疗效好，也用于单纯及复杂部分性发作，对发热惊厥有预防作用（E错）。（八版药理学P156）苯二氮卓类1.地西泮（安定）是治疗癫痫持续状态的首选药物，静脉注射显效快且较其他药物安全（A错）。(八版药理学P155）扑米酮又称去氧苯比妥或扑痫酮，化学结构类似苯巴比妥，与苯巴比妥相比无特殊优点，且价格较贵，仅用于其他药物无效的患者（B错）。